男，35岁。右上臂外伤6小时。查体：局部肿胀、压痛、畸形，伴异常活动，垂腕、垂指。最可能的诊断是
A. 肱骨外科颈骨折合并腋神经损伤
B. 肱骨外科颈骨折合并肌皮神经损伤
C. 肱骨干骨折合并桡神经损伤
D. 肱骨干骨折合并尺神经损伤
E. 肱骨干骨折合正中神经损伤

正确答案：C。肱骨干骨折合并桡神经损伤

解析：患者青年男性，右上臂外伤6小时。查体：局部肿胀、压痛、畸形，伴异常活动，垂腕、垂指（肱骨干骨折合并桡神经损伤典型表现）。根据患者病史、临床表现最可能的诊断是肱骨干骨折合并桡神经损伤（C对）。肱骨外科颈为肱骨大结节、小结节移行为肱骨干的交界部位，在解剖颈下2-3cm，有臂丛神经、腋血管通过，有发生骨折合并血管神经损伤的可能（P632），因此肱骨外科颈骨折不合并腋神经（A错）、肌皮神经损伤（B错）。肱骨下端前后扁，内上髁后面有一浅沟，为尺神经沟，有尺神经通过，当内上髁骨折时，容易损伤此神经（D错）。正中神经在腋部由臂丛外侧束与内侧束共同形成，在臂部沿肱二头肌内行走，肱骨干骨折时正中神经损伤不易损伤（E错）。